以下哪项描述是正确的
A. 行为和生活方式已经是十分明确的危险因素
B. 行为和生活方式是目前尚不清楚的危险因素
C. 行为和生活方式不能肯定是健康的危险因素
D. 行为和生活方式只是最近才产生的健康危险因素
E. 行为和生活方式不能对健康产生直接的危害

正确答案：A。行为和生活方式已经是十分明确的危险因素